男，38岁，间歇性浮肿10余年，伴恶心、呕吐1周。查血红蛋白80g/L，血压20.7/14.7kPa（155/110mmHg），尿蛋白++，颗粒管型2～3个/HP，尿比重1.010～1.012。为了解该患者双侧肾脏是否已缩小，应首选的检查是
A. 静脉肾盂造影
B. ECT
C. CT
D. 同位素肾图
E. B超

正确答案：E。B超

解析：患者初步诊断为慢性肾小球肾炎，病变进展至后期，所有不同类型病理变化均可进展为程度不等的肾小球硬化，相应肾单位的肾小管萎缩、肾间质纤维化，晚期肾脏体积缩小、肾皮质变薄。为了解该患者双侧肾脏是否已缩小，应首选的检查是B超（E对）。B超不仅可以观察肾脏形态，且为无创检查，价格低廉。ECT（B错）、CT（C错）主要用于了解肾脏的形态改变，但由于价格昂贵，一般不作为首选检查。静脉肾盂造影（A错）常用于慢性肾盂肾炎的诊断。同位素肾图（D错）主要用于单侧肾脏病变的诊断、尿路梗阻的程度判断以及有无肾功能损害等。